2岁前生活在高氟区、以后迁移至非高氟区则
A. 仅累及前牙和第一恒磨牙
B. 仅累及前牙和第二恒磨牙
C. 仅累及尖牙和第一前磨牙
D. 仅累及前磨牙和第一恒磨牙
E. 仅累及前磨牙和第二恒磨牙

正确答案：A。仅累及前牙和第一恒磨牙

解析：患氟牙症牙数目的多少，取决于牙发育矿化时期在高氟区生活时间的长短，出生至出生后在高氟区居住多年，可使全口牙受侵害；如2岁前生活在高氟区，以后迁移至非高氟区，氟牙症可仅累及前牙和第一恒磨牙；如果6～7岁以后再迁入高氟区，则不会出现氟牙症。掌握“氟毒性及氟牙症”知识点。